关于儿童药动学和药效学特点的说法，错误的是
A. 和成人相比，婴儿胃液pH低，对酸不稳定的药物易被破坏
B. 儿童内分泌系统不够稳定，长期使用糖皮质激素易导致发育迟缓
C. 婴幼儿血浆白蛋白与药物的结合能力低于成人，血中游离型药物浓度较高
D. 儿童血-脑屏障不完善，多种药物均能通过，有可能引发不良反应
E. 儿童水、电解质调节及平衡功能较差，不宜轻易使用泻下药

正确答案：A。和成人相比，婴儿胃液pH低，对酸不稳定的药物易被破坏

解析：本题考查儿童药动学和药效学特点。小儿胃容量小，胃酸分泌少，胃液pH较高（A错，为本题正确答案）（至2～3岁方接近成人水平），胃排空慢，肠蠕动不规则，胆汁分泌功能不完全；上述因素使主要在胃内吸收的药物吸收较完全，而主要在十二指肠吸收的药物吸收减少。与成人相比，对酸不稳定的药物、弱碱性药物的吸收增加，而弱酸性药物吸收减少。儿童期内分泌系统不够稳定，许多激素和抗激素制剂会扰乱儿童内分泌功能，导致甲状腺、甲状旁腺、肾上腺、垂体等功能发生变化，影响生长发育。糖皮质激素可影响糖、蛋白质、脂肪代谢，长期服药会导致发育迟缓（B对）、身材矮小、免疫力低下。人参、蜂皇浆等中药可影响垂体分泌；促性腺激素类药物可影响儿童性腺发育，导致儿童性早熟；对氨基水杨酸、磺胺类可抑制甲状腺激素合成，造成生长发育障碍。婴幼儿血浆白蛋白与药物的结合能力低于成人，药物在血中的游离型浓度增高（C对），较多药物分布于组织之中，如达到与成人相当的血浆浓度，则进入组织的药物更多，极易引起中毒。儿童期血-脑屏障不完善，多种药物均能通过，有可能引发不良反应（D对）。儿童期体内水、电解质调节及平衡功能较差，易致脱水与电解质紊乱，因此对泻下药、利尿药比较敏感；长期禁食容易出现低血钾、低血钠、严重呕吐，腹泻患儿容易出现脱水、酸中毒；因此儿童不宜轻易使用泻下药（E对）。